磷酸吡哆醛作为辅酶参与的反应是
A. 转甲基反应
B. 过氧化反应
C. 磷酸化反应
D. 转氨基反应
E. 酰基化反应

正确答案：D。转氨基反应